女性，30岁。近两年间断发生尿路刺激症状，无发热，尿检查有白细胞和白细胞管型，尿细菌培养阳性。其诊断是
A. 急性肾盂肾炎
B. 慢性肾炎
C. 慢性肾盂肾炎
D. 急性膀胱炎
E. 肾结核

正确答案：C。慢性肾盂肾炎

解析：女性，30岁（尿路感染的高发人群），两年（病程较长）来间断发生尿路刺激症状，无发热（全身及泌尿系统局部症状不典型），尿检查有白细胞管型（肾盂肾炎可有白细胞管型），尿细菌培养阳性（提示真性菌尿，确诊为尿路感染），综合该患者的病史、体查、实验室检查，其诊断是慢性肾盂肾炎（C对）。急性肾盂肾炎（P498）（A错）起病较急，有寒战、高热表现。慢性肾炎（P474）（B错）起病缓慢，病程较长，主要表现为蛋白尿、血尿、高血压和水肿等。急性膀胱炎（P498）（D错）起病较急，尿检查无白细胞管型。肾结核（八版外科学P561-P562）（E错）膀胱刺激征尤为突出，常有终末血尿，普通尿细菌培养阴性。